微波的波长范围在
A. 1mm～1cm
B. 1cm～10cm
C. 10cm～1m
D. 1mm～1m

正确答案：D。1mm～1m

解析：本题考查微波的定义。波长在1mm～1m（D对ABC错）的电磁波称微波，其强度常用功率密度表示。与高频电磁场相比，微波的波长短、频率高、量子能量大。微波随频率、波长不同又分成分米波、厘米波和毫米波。